男性，40岁。因发热，便秘，食欲不振12天入院。查体：肝大，肋下lcm，软，脾肋下一指。血常规WBC2.7×10⁹/L，中性粒细胞52%，淋巴细胞44%，血清ALT120U/L，肥达反应：“O”1：160，“H”1：160。病原治疗最合适的药物是
A. 环丙沙星
B. 复方新诺明
C. 青霉素
D. 庆大霉素
E. 红霉素

正确答案：A。环丙沙星

解析：环丙沙星（喹诺酮类药物）为伤寒经验治疗的首选药物（A对）。青霉素（C错）对革兰阴性杆菌治疗无效。复方新诺明（磺胺类药）（B错）主要用于敏感菌株的治疗，不作为伤寒的首选药。庆大霉素（D错）红霉素（E错）不常用于伤寒治疗。